某县历年流脑发病率均在12/10万～20/10万之间，去年该县流脑发病率为16/10万，试判断其流行强度
A. 散发
B. 暴发
C. 流行
D. 大流行
E. 以上均不对

正确答案：A。散发

解析：本题考查散发的概念。散发（A对BCDE错）指发病率呈历年的一般水平，各病例间在发病时间和地点上无明显联系，表现为散在发生。散发一般是对于范围较大的地区而言。确定散发时多与当地近三年该病的发病率进行比较，如果当年发病率未明显超过既往平均水平称为散发。